男性，75岁。进行性排尿困难6个月，直肠指诊发现前列腺右侧有2cm×2cm硬结，1周后行PSA检查为120mg/ml，核素全身骨扫描示骨盆及腰椎系统反射性浓聚区，诊断为前列腺癌骨转移，对此患者现最适宜的治疗是
A. 根治性前列腺切除+放射治疗
B. 根治性前列腺切除+化疗
C. 根治性前列腺切除+盆腔淋巴结清扫
D. 前列腺切除+综合治疗
E. 双睾丸切除+抗雄激素药物+放射治疗

正确答案：E。双睾丸切除+抗雄激素药物+放射治疗

解析：老年男性患者，确诊为前列腺癌骨转移，核素全身骨扫描示骨盆及腰椎系统有反射性浓聚区，提示患者已为T4期。对于T3、T4期前列腺癌以内分泌治疗为主，可行睾丸切除术，配合非类固醇类抗雄激素制剂，外放射可治疗有癌扩散的骨盆及腰椎系统，故对此患者现最适宜的治疗是双睾丸切除+抗雄激素药物+放射治疗（E对）。根治性前列腺切除术（ABC错）仅适用于年龄较轻、能耐受手术的局限在前列腺包膜以内（T1b、T2期）的癌，前列腺切除的同时行局部盆腔淋巴结清扫术。放射治疗适用于局部有扩散的前列腺癌，尤其是内分泌治疗无效的病人。化疗主要适用于非雄激素依赖的晚期前列腺癌治疗。